患者男性，56岁。被发现昏倒在煤气热水器浴室内。查体：浅昏迷，血压160/90mmHg，口唇樱红色，四肢无瘫痪，尿糖（++），尿酮体（-），首先考虑的诊断是
A. 脑出血
B. 急性心肌梗死
C. 糖尿病酮症酸中毒
D. 脑梗死
E. 急性一氧化碳中毒

正确答案：E。急性一氧化碳中毒